阿托品不良反应不包括
A. 口干
B. 缩瞳
C. 视力模糊
D. 心率加快
E. 皮肤潮红

正确答案：B。缩瞳

解析：阿托品常见的不良反应有口干、视力模糊、心率加快、瞳孔扩大及皮肤潮红等。随着剂量增大，其不良反应逐渐加重，甚至出现明显中枢中毒症状。掌握“阿托品”知识点。